下列关于受精的叙述，正确的是
A. 卵子停留在输卵管峡部等待受精
B. 精子获能的主要部位是阴道
C. 精子与卵子相遇时发生顶体反应
D. 精子与卵子相遇，标志受精过程已开始
E. 精原核与卵原核相融合，标志受精过程即将完成

正确答案：C。精子与卵子相遇时发生顶体反应

解析：当精子与卵子相遇，精子头部外膜与顶体前膜融合破裂，形成小孔释放出顶体酶，可溶解卵子外围的放射冠和透明带，这一过程称为顶体反应（C对）。卵子从卵巢排出后进入腹腔，经输卵管伞端的“拾卵”作用，进入输卵管壶腹部与峡部连接处等待受精（A错）。精子进入宫腔及输卵管腔，精子表面的糖蛋白被生殖道分泌物中的α与β淀粉酶降解，同时顶体膜结构中胆固醇与磷脂比率和膜电位发生变化，降低顶体膜稳定性，此时的精子具有受精能力，此过程称为精子获能（B错）。获能的单倍体精子穿过次级卵母细胞透明带为受精的开始（D错），而卵原核与精原核融合为受精的完成（E错）。